肛瘘治疗过程中，最重要的是确定
A. 肛周皮肤是否有外口
B. 肛瘘分泌物细菌培养结果
C. 肛瘘与肛门括约肌解剖关系
D. 肛瘘有几个内口
E. 肛瘘有几个外口

正确答案：C。肛瘘与肛门括约肌解剖关系

解析：肛瘘很难自愈，多需手术治疗。选择手术方式应根据肛瘘是否累及括约肌，或累及括约肌的多少来决定（八版黄家驷外科学P1609），最重要的是确定肛瘘与肛门括约肌解剖关系（C对）。肛周皮肤是否有外口（A错）、肛瘘分泌物细菌培养结果（B错）、肛瘘有几个内口（D错）、肛瘘有几个外口（E错）为肛瘘诊断的常规检查。